与下颌骨发育有关的软骨为
A. 第一鳃弓软骨
B. 第二鳃弓软骨
C. 第三鳃弓软骨
D. 第四鳃弓软骨
E. 第五鳃弓软骨

正确答案：A。第一鳃弓软骨

解析：第一鳃弓软骨与下颌骨的发育有关。掌握“鳃弓与神经嵴”知识点。